下列各项，不属心力衰竭诊断标准的是
A. 安静时心率增快，婴儿>180次/分，幼儿>160次/分，不能用发热或缺氧解释
B. 呼吸困难，青紫突然加重，安静时呼吸达60次/分以上
C. 突然烦躁不安，面色苍白或发灰
D. 心音明显低钝，或出现奔马律
E. 尿量增加

正确答案：E。尿量增加

解析：不属心力衰竭诊断标准的是尿量增加，心衰早期，神经-体液调节机制激活，机体动员心脏本身和心脏以外的多种机制进行代偿，机体可通过加快心率、心肌肥厚和心脏扩大等，以调整排血量，满足机体组织器官的需要，此期属心功能代偿期。如基本病因持续存在，即使通过代偿亦不能满足机体的需要，即出现心力衰竭。特征为心排血量不足，肺循环和（或）体循环淤血，出现静脉回流受阻、体内水分潴留、脏器淤血等表现（E错，为本题正确答案）。